二级信息进行评价的标准包括
A. 收载杂志数量
B. 受试体数量
C. 临床诊断标准
D. 出版或更新频率
E. 检索路径数量

正确答案：A、D、E。收载杂志数量；出版或更新频率；检索路径数量

解析：本题考查二级信息评价标准。对于二级信息的评价内容包括：收载杂志的数量（A对）、出版或更新频率（D对）、检索路径数量（E对）、专业种类、索引的完备程度及服务费用的高低。受试体数量（B错）、临床诊断标准（C错）属于一级信息源评价标准。